寒湿腰痛的治疗主方是
A. 青蛾丸
B. 独活寄生汤
C. 四妙丸
D. 甘姜术汤苓
E. 当归拈痛汤

正确答案：D。甘姜术汤苓

解析：寒湿腰痛为寒湿留着，闭阻经脉所致；治宜散寒祛湿，温经通络；方选甘姜苓术汤，本方具有温中、散寒、化湿的作用，适用于寒湿闭阻经脉而致腰脊疼痛证（D对）。青娥丸功效补肾壮腰止痛，用于肾虚腰痛，起坐不利，膝软乏力（A错）。独活寄生汤功效祛风湿，止痹痛，益肝肾，补气血，主治痹证日久，肝肾两虚，气血不足证（B错）。四妙丸功效清热利湿，舒筋壮骨，主治湿热痿证（C错）。当归拈痛汤功效利湿清热，疏风止痛，主治湿热相搏，外受风邪证（E错）。